对于易水解的药物制剂生产中原料的水分一般控制在
A. 0.5%以下
B. 1.0%以下
C. 2.0%以下
D. 3.0%以下
E. 4.0%以下

正确答案：B。1.0%以下

解析：本题考查固体制剂原料的水分控制。易水解的药物制剂，生产原料水分含量一般控制在1%以下（B对）。